DNA复制的主要方式是
A. 半保留复制
B. 全保留复制
C. 弥散式复制
D. 不均一复制
E. 以上都不是

正确答案：A。半保留复制